窦房结细胞动作电位0期去极化的原因
A. Na⁺内流
B. Ca²⁺内流
C. Cl⁻内流
D. K⁺内流
E. K⁺外流

正确答案：B。Ca²⁺内流

解析：窦房结细胞的跨膜电位及其产生机制明显不同于心室肌细胞。心室肌0期去极化的离子机制为Na⁺通道（快钠通道）介导的Na⁺内流；窦房结P细胞缺乏INa通道，其去极化主要依赖于L型钙通道（慢钙通道）介导的Ca²⁺内流（B对）。